属于DNA病毒的是
A. HAV
B. HBV
C. HCV
D. HDV
E. HEV

正确答案：B。HBV